目前我国最常用的智力量表是
A. 斯坦福-比纳智力量表
B. 洛奇-桑代克智力量表
C. 韦克斯勒智力量表
D. 瑟斯顿智力量表
E. 勒特国际操作量表

正确答案：C。韦克斯勒智力量表

解析：韦克斯勒智力量表：韦克斯勒于1939年编制了Wechsler-Bellevue量表（简称W-BI），1995年W-BI经修订后成为目前使用的韦克斯勒成人智力量表（WAIS）。1981年以后我国的心理学家对此量表进行修订，产生了便于我国文化背景使用的韦克斯勒量表。掌握“常用的心理测验及临床评定测量表”知识点。